下列哪项结构不属于下颌下三角的内容
A. 下颌下腺
B. 面动脉
C. 面静脉
D. 舌下腺
E. 舌神经

正确答案：D。舌下腺

解析：下颌下三角的内容：下颌下腺、下颌下淋巴结、面静脉、面动脉、舌神经、下颌下腺导管、舌下神经。掌握“颈部分区、颈筋膜层次及下颌下三角解剖特点”知识点。